关于医学伦理学的任务，错误的是
A. 反映社会对医学的需求
B. 为医学的发展导向
C. 为符合道德的医学行为辩护
D. 努力解决医学活动中产生的伦理问题
E. 满足患者的所有要求和利益

正确答案：E。满足患者的所有要求和利益

解析：尊重原则是指医务人员尊重病人的伦理原则，其实现取决于医务人员对其合理性的认同以及医患之间平等关系的认可和构建，并不是指满足患者的所有要求和利益（E错，为本题正确答案）。医学伦理学的任务有：①确定符合时代要求的医德和规范；②反映社会对医学的需求（A对）；③为医学的发展导向（B对）；④为符合道德的医学行为辩护（C对）；⑤努力解决医学活动中产生的伦理问题（D对）。